1.4-二氢吡啶环的2位为2-氨基乙氧基甲基，外消旋体和左旋体均已用于临床的药物是
A. 硝苯地平
B. 尼群地平
C. 尼莫地平
D. 氨氯地平
E. 非洛地平

正确答案：D。氨氯地平

解析：本题考查氨氯地平的结构。氨氯地平（D对）与其它二氢吡啶类钙通道阻滞剂不同，氨氯地平分子中的1，4-二氢吡啶环的2位甲基被2-氨基乙氧基甲基取代，3，5位羧酸酯的结构不同，因而4位碳原子具手性，可产生两种光学异构体，临床用外消旋体和左旋体。硝苯地平（A错）为对称结构的二氢吡啶类药物，可通过扩张周边血管，降低血压，改善脑循环。用于治疗冠心病，缓解心绞痛。尼群地平（B错）为选择性作用于血管平滑肌的钙通道阻滞剂，能降低心肌耗氧量，对缺血性心肌有保护作用。尼莫地平（C错）容易通过血-脑屏障，选择性扩张脑血管，具有抗缺血和抗血管收缩作用。非洛地平（E错）为选择性钙离子拮抗药，临床用于治疗高血压。